深部脓肿的特点是
A. 局部红、肿、热、痛明显
B. 局部波动感明显
C. 全身中毒症状
D. 局部水肿、压痛明显，穿刺可抽出脓液
E. 局部仅有水肿现象，但无压痛

正确答案：D。局部水肿、压痛明显，穿刺可抽出脓液

解析：深部脓肿波动感可不明显，但局部有压痛，可有发热与白细胞计数增加，穿刺有脓液抽出。掌握“外科感染”知识点。